患者，女，51岁，体检时发现血160/105mmHg，量试验餐后2小时血糖为9.56mmol/L（参考范围＜7.8mmol/L），甘油三酯0.52mmol/L（参考范围0.56～1.70mmol/L），总胆固醇6.26mmol/L（参考范围＜0.2mmoL），低密度脂蛋白胆固醇4.85mmol/L（参考范围2.1～3.1mmol/L），高密度脂蛋白胆固醇1.20mmol/L（参考范围1.2～1.65mmol/L，肌酐60㎛ol/L（参考范围45～84㎛ol/M），蛋白尿：++。临床诊断为高血压病、高脂血症、糖耐量异常。该患者首选的调节血脂药是
A. 依折麦布
B. 普罗布考
C. 非诺贝特
D. 阿托伐他汀
E. 多烯酸乙酯

正确答案：D。阿托伐他汀

解析：本题考查调节血脂药。他汀类药物适用于高胆固醇血症和以胆固醇升高为主的混合型高脂血症，该患者应选用阿托伐他汀（D对）。